患者最可能的诊断是
A. 自身免疫性溶血性贫血
B. 巨幼细胞性贫血
C. Evans综合征
D. 地中海贫血
E. 缺铁性贫血

正确答案：A。自身免疫性溶血性贫血

解析：患者青年女性，头晕、心悸、乏力3个月（贫血表现），查体：贫血貌，巩膜轻度黄染（黄疸），肝脾肿大（符合血管外溶血表现），实验室检查：Hb75g/L（成年女性110～150g/L），RBC2.5×10¹²/L（成年女性正常3.5～5.0×10¹²/L），提示贫血，WBC8.2×10⁹/L（4～10×10⁹/L），Plt151×10⁹/L（100～300×10⁹/L），网织红细胞0.12（0.005～0.015）增高，提示骨髓红系代偿性增生（符合溶血性贫血的变化），Coombs试验（+）（温抗体型自身免疫性溶血性贫血的最具诊断意义的试验），故患者最可能的诊断为自身免疫性溶血性贫血（A对）。巨幼红细胞贫血（B错）网织红细胞计数可正常，严重者全血细胞减少，可有精神、神经系统症状，无黄疸、肝脾肿大表现；Evans综合征（C错）为自身免疫性溶血性贫血合并免疫性血小板减少；地中海贫血（D错）为遗传性疾病，有阳性家族史；缺铁性贫血（E错）网织红细胞计数正常或轻度升高，常有组织缺铁的表现，无黄疸、肝脾肿大。